由特异性病原体及其毒性产物经由中介的动物宿主传染给易感宿主可称为
A. 传染病
B. 感染性疾病
C. 传播途径
D. 传染源
E. 传播

正确答案：A。传染病

解析：传染病是指由特异病原体（或它们的毒性产物）所引起的一类疾病：这种病原体及其毒性产物可以通过感染的人、动物或储存宿主直接或间接方式（经由中介的动物宿主、昆虫、植物宿主或其他环境因素）传染给易感宿主。掌握“传染病预防及控制”知识点。